劳动者可以在以下机构进行职业病诊断
A. 用人单位所在地的医疗卫生机构
B. 本人居住地的医疗卫生机构
C. 用人单位所在地或者本人居住地依法承担职业病诊断的医疗卫生机构
D. 用人单位所在地或者本人居住地依法承担职业病诊断的医疗卫生防疫机构
E. 用人单位所在地依法承担职业病诊断的疾病防治机构

正确答案：C。用人单位所在地或者本人居住地依法承担职业病诊断的医疗卫生机构